痰热内蕴者可见
A. 类剥苔
B. 黄腻苔
C. 薄黄苔
D. 灰黑而润苔
E. 灰黑而干苔

正确答案：B。黄腻苔

解析：黄苔而质腻者，称黄腻苔，主湿热或痰热内蕴（B对），或为食积化腐。剥（落）苔主胃气不足，胃阴损伤，或气血两虚。剥（落）苔的形成，总因胃气匮乏，不得上熏于舌，或胃气损伤，不能上潮于舌所致。类剥苔属于剥（落）苔的一种（A错）。舌苔由白转黄，或呈黄白相兼，多为外感表证处于化热入里，表里相兼阶段（C错）。在寒湿病中出现灰黑苔，多由白苔转化而成，其舌苔灰黑必湿润多津（D错）。舌焦黑干燥，舌质干裂起刺者，无论外感或内伤，均为热极津枯之征（E错）。